平均稳态血药浓度是
A. Cmax
B. t1/2
C. AUC
D. MRT
E. Css（平均稳态血药浓度）

正确答案：E。Css（平均稳态血药浓度）

解析：本题考查药动学参数。稳态血药浓度用Css表示（E对）；Cmax（A错）为峰浓度；t1/2（B错）为生物半衰期；AUC（C错）表示血药浓度-时间曲线下面积；MRT（D错）为药物在体内的平均滞留时间。